中型药品零售企业的营业场所和仓库面积不应低于
A. 药品营业场所的面积为50平方米，仓库为30平方米
B. 药品营业场所的面积米为50平方米，仓库为20平方米
C. 药品营业场所的面积为40平方米，仓库为20平方米
D. 药品营业场所面积为40平方米，仓库为30平方米
E. 药品营业场所面积为60平方米，仓库为30平方米

正确答案：B。药品营业场所的面积米为50平方米，仓库为20平方米